下列各项，不属清燥救肺汤组成的药物是
A. 石膏
B. 石斛
C. 桑叶
D. 阿胶
E. 人参

正确答案：B。石斛

解析：本题考查清燥救肺汤的组成。清燥救肺汤由桑叶（C错）、石膏（A错）、甘草、胡麻仁、真阿胶（D错）、枇杷叶、人参（E错）、麦门冬、杏仁组成（B对）。方歌：清燥救肺桑麦膏，参胶胡麻杏杷草，清宣润肺养气阴，温燥伤肺气阴耗。